应注意避开血管针刺的是
A. 太渊
B. 鱼际
C. 列缺
D. 合谷
E. 血海

正确答案：A。太渊

解析：该题主要考察腧穴的定位和操作。太渊位于腕前区，桡骨茎突与舟状骨之间，拇长展肌腱尺侧凹陷中，针刺时需避开挠动脉即避开血管直刺（A对）。鱼际位于手外侧，第一掌骨桡侧中点赤白肉际处，可直接直刺（B错）。列缺位于前臂，腕掌侧远端横纹上1.5寸，拇短伸肌腱和拇长展肌腱之间，拇长展肌腱沟的凹陷中，可直接向上斜刺（C错）。合谷位于手背，第2掌骨挠侧的中点处，可直接直刺（D错）。